皮瓣移植的术后为了防止血管痉挛，游离皮瓣术后要保持室温在
A. 11℃左右
B. 15℃左右
C. 18℃左右
D. 21℃左右
E. 25℃左右

正确答案：E。25℃左右

解析：皮瓣移植的术后观察和处理：游离皮瓣术后要保持室温在25℃左右，以防血管痉挛；同时应用扩张血管及抗菌药物。掌握“皮片移植”知识点。